不加Hg（Ac）₂，以结晶紫为指示剂，用HClO₄直接滴定的药物有
A. 硫酸奎尼丁
B. 硝酸士的宁
C. 盐酸吗啡
D. 磷酸可待因
E. 氢溴酸山莨菪碱

正确答案：A、D。硫酸奎尼丁；磷酸可待因